能清除菌斑中内毒素的是
A. 氯己定
B. 酚类化合物
C. 季铵化合物
D. 氟化亚锡
E. 三氯羟苯醚

正确答案：B。酚类化合物

解析：本题考查化学制剂控制菌斑。能清除菌斑中内毒素的是酚类化合物（B对）。1.氯己定（洗必泰）（A错）：二价阳离子表面活性剂，减少了唾液中能吸附到牙面上的细菌数；抑制获得性膜和菌斑的形成；阻碍了唾液细菌对牙面的吸附；洗必泰与Ca²⁺竞争，抑制了细菌的聚积和对牙面的吸附。主要用于局部含漱、涂擦和冲洗，0.12%或0.2%洗必泰液含漱，每天2次，每次10ml。副作用：对口腔黏膜有轻度的刺激作用；使牙、修复体或舌背上发生染色；味苦。2.酚类化合物：麝香草酚、薄荷醇和甲基水杨酸盐混合而成的抗菌斑制剂；可减少菌斑量及降低龈炎指数；能清除菌斑中的内毒素，可明显降低菌斑的毒性。3.季铵化合物（C错）：阳离子表面活性剂，能杀灭革兰阳性和革兰阴性细菌，特别对革兰阳性菌有较强的杀灭作用。一般以0.05%的浓度作为漱口剂，可抑制菌斑的形成和牙龈炎的发生。长期使用可能出现牙染色、烧灼感或促进牙结石的形成等副作用。4.氟化亚锡（D错）：抑制细菌粘附，生长和碳水化物代谢，使细菌生长明显减少，干扰菌斑代谢过程，降低菌斑毒力；减少牙本质过敏；抑制菌斑形成。5.三氯羟苯醚（E错）：广谱抗菌剂，有效抑制多种革兰阳性与阴性细菌。